对年老体弱痰量较多且无力咳痰的慢性支气管炎患者，不宜使用的药物为
A. 氧氟沙星
B. 溴己新
C. 羧甲司坦
D. 氨溴索
E. 可待因

正确答案：E。可待因

解析：老年体弱痰量较多且无力咳痰的慢性支气管炎患者，不宜使用镇咳药，包括可待因（E错，为本题正确答案）、氢溴酸右美沙芬等，否则容易导致痰液集聚在呼吸道，引起继发性感染。可以应用祛痰药，如溴已新（B对）、羧甲司坦（C对）、氨溴索（D对）等。慢性支气管炎患者，痰量较多时，可能是伴发了感染，故可以应用抗生素，如氧氟沙星（A对）。